《中国药典》规定，不检查水分的丸剂是
A. 水丸
B. 糊丸
C. 蜡丸
D. 滴丸
E. 小蜜丸

正确答案：C。蜡丸

解析：本题考查丸剂的质量要求。除另有规定外，蜡丸（C对）不检查水分，蜜丸和浓缩蜜丸（E错）中所含水分不得过15.0%；水蜜丸和浓缩水蜜丸不得过12.0%；水丸（A错）、糊丸（B错）、浓缩水丸不得过9.0%。